可见草莓舌的疾病是
A. 麻疹
B. 风疹
C. 水痘
D. 猩红热
E. 幼儿急疹

正确答案：D。猩红热

解析：猩红热病初舌被白苔，红肿的乳头突出于白苔之外，称为白草莓舌；以后白苔脱落，露出鲜红舌面，舌乳头红肿明显并持续存在，称红草莓舌（D对）。另外，皮肤黏膜淋巴结综合征也可见草莓舌。麻疹（A错）是小儿时期常见的一种急性呼吸道传染病，临床以发热、上呼吸道炎症、结膜炎、麻疹粘膜斑及全身斑丘疹为特征。风疹（B错）是由风疹病毒引起的急性呼吸道传染病，临床以发热，皮疹及耳后、枕后、颈部淋巴结肿大和全身症状轻微为特征。水痘（C错）为小儿常见急性出疹性传染病，临床特征为发热，皮肤粘膜分批出现的瘙痒性斑、丘、疱疹及结痂，且上述各期皮疹可同时存在。幼儿急疹（E错）又称婴儿玫瑰疹，是人类疱疹病毒6、7型导致的婴幼儿期常见的一种发疹性热病，以持续高热3～5天，热退疹出为临床特点。